腰丛
A. 位于腰大肌深面
B. 由L1-L3前支组成
C. 经腹股沟韧带深面
D. 发出坐骨神经等分支
E. 分布于大腿肌

正确答案：A。位于腰大肌深面

解析：腰丛由第12胸神经前支的一部分、第1-3腰神经前支及第4腰神经前支的一部分组成（B错）。腰丛位于腰大肌深面（A对）、腰椎横突的前方。该丛发出的分支除就近支配位于附近的髂腰肌和腰方肌外，尚发出许多分支分布于腹股沟区、大腿前部和大腿内侧部（E错）。